仅少数病人出现的与遗传性生化缺陷有关的不良反应为
A. 继发反应
B. 毒性反应
C. 特异质反应
D. 后遗效应
E. 停药反应

正确答案：C。特异质反应

解析：本题考查药品不良反应。仅少数病人出现的与遗传性生化缺陷有关的不良反应为特异质反应（C对）。特异质反应是指因先天性遗传异常，少数患者用药后发生与药物本身的药理作用无关的有害反应。继发反应（A错）是继发于药物治疗作用之后的不良反应，是治疗剂量下治疗作用本身带来的间接结果。毒性反应（B错）是指在药物剂量过大或体内积蓄过多时发生的危害机体的反应。后遗效应（D错）是指在停药后血药浓度已降低至最低有效浓度以下时仍残存的药理效应。停药反应（E错）是指患者长期应用某种药物，突然停药后出现原有疾病加剧的现象，又称回跃反应或反跳。